《素问·脉要精微论》中所述“泛泛乎万物有余”的脉象对应的时间是
A. 秋日
B. 春日
C. 冬日
D. 夏日
E. 长夏

正确答案：D。夏日

解析：一年间气候变化的规律一般是春温、夏热、秋凉、冬寒，顺应这种规律，人体的脉象也相应出现“春日浮，如鱼之游在波”（B错）、“夏日在肤，泛泛乎万物有余”（D对）、“秋日下肤，蛰虫将去”（A错）、“冬日在骨，蛰虫周密”（C错）的规律性变化。